肉毒毒素主要侵犯
A. 肝
B. 感觉神经
C. 肾
D. 运动神经
E. 循环系统

正确答案：D。运动神经